醋酸氢化可的松溶液润湿剂为
A. 硫柳汞
B. 氯化钠
C. 聚山梨酯80
D. 羧甲基纤维素钠
E. 注射用水

正确答案：C。聚山梨酯80

解析：本题考查混悬剂。醋酸氢化可的松溶液处方分析：①主药-醋酸可的松；②抑菌剂-硝酸苯汞；③助悬剂-羧甲基纤维素钠；④表面活性剂-吐温80；⑤渗透压调节剂-硼酸；⑥溶剂-蒸馏水。聚山梨酯80（C对）是表面活性剂，可作为润湿剂使用。硫柳汞（A错）为液体制剂常用的防腐剂。氯化钠（B错）为液体制剂常用的渗透压调节剂。羧甲基纤维素钠（D错）为高分子助悬剂。注射用水（E错）为常用的溶剂。